男，26岁。在工厂被锅炉高温蒸汽烫伤双下肢和臀部，伤处红肿明显，有大小不一的水疱形成，内含淡黄的澄清液体，创面红润、潮湿。若该患者体重为50kg，检查：意识清，能合作，心率100次/分，血压16.0/11.2kPA(120/84mmHg)，下午5时开始静脉输液，6时入手术室、清创，晚上8时送病房。烧伤后第一个24h总量为
A. 5600ml
B. 6200ml
C. 6800ml
D. 5450ml
E. 6000ml

正确答案：D。5450ml

解析：男性双下肢和臀部烧伤面积为46％，第一个24h补液方案为：总液体量=丢失量+生理需要量（2000ml），丢失量=体重×烧伤面积（Ⅱ度、Ⅲ度）×1.5，故该患者第一个24小时补液总量为46×50×1.5+2000=5450ml（D对）。